灵敏度是指
A. 试验检出阴性的人数占无病者总数的比例
B. 试验检出阳性的人数占有病者总数的比例
C. 筛检阴性者中真正成为非患者的可能性
D. 筛检方法能将实际有病的人正确地判为阳性的能力
E. 试验检出阳性的人数占无病者总数的比例

正确答案：D。筛检方法能将实际有病的人正确地判为阳性的能力